预防医学控制疾病发生两大关口
A. 防疫和食品卫生
B. 管理与监督
C. 卫生知识的宣传与检查
D. 对传染病、地方病、流行病进行调查与隔离
E. 及时上报与及时隔离传染病

正确答案：A。防疫和食品卫生